正式发动分娩的主要表现为
A. 见红
B. 下腹隐痛
C. 宫颈变软
D. 规律宫缩
E. 胎先露部衔接

正确答案：D。规律宫缩